富含维生素A的食物是
A. 粮谷类
B. 动物肝脏
C. 猕猴桃
D. 奶及奶制品
E. 马铃薯

正确答案：B。动物肝脏

解析：植物中无维生素A（ACE错）。动物性食品，如肝（B对）、肉类、蛋黄、奶及奶制品（D对）、鱼肝油等都是维生素A的丰富来源，但B选项动物肝脏维生素A来源更丰富，为最佳选项。